女，35岁。近半年经期延长至8-10天，月经第3-4天量多，既往月经规律，周期28天。8年前顺产分娩，其基础体温最可能是
A. 基础体温呈双相型，持续高温期
B. 基础体温呈双相型，高温期短于11天
C. 基础体温呈双相型，下降缓慢
D. 基础体温呈双相型，上升缓慢
E. 基础体温呈单相型

正确答案：C。基础体温呈双相型，下降缓慢

解析：患者中青年女性，月经周期正常（提示卵泡发育正常），但经期延长，且出血量多（提示黄体萎缩不全，循环高孕激素水平），最可能的诊断为由子宫内膜不规则脱落引起的排卵性异常子宫出血。该疾病主要由黄体萎缩不全，内膜持续受孕激素影响 ，不能如期完整脱落造成，因孕激素有提高中枢兴奋性，升高基础体温的作用。故基础体温呈双相型，下降缓慢（C对）。无排卵性基础体温呈单相型（E错）见于无排卵性异常子宫出血，患者月经周期紊乱（P335）。础体温呈双相型，高温期短于11天（B错）见于由黄体功能不全导致的排卵性异常子宫出血，患者常常月经周期缩短（P339）。